女，25岁。间断牙龈出血、皮肤瘀斑2个月，反复发生口腔溃疡。查体：双下肢和腹部散在瘀斑，浅表淋巴结无肿大，巩膜无黄染，腹软，肝肋下未及，脾肋下刚可触及。化验：Hb121g/L，WBC4.5×10⁹/L，PLT25×10⁹/L，为除外继发性免疫性血小板减少性紫癜，最重要的检查是
A. 血小板功能
B. 血小板抗体
C. 抗核抗体谱
D. 腹部B超
E. 胸部X线片

正确答案：B。血小板抗体

解析：患者青年女性，间断牙龈出血、皮肤瘀斑2个月，反复发生口腔溃疡。查体：双下肢和腹部散在瘀斑，提示出血（ITP患者血小板减少有出血倾向，常表现为皮肤、黏膜出血，如瘀点、瘀斑、紫癜，鼻出血、牙龈出血等），肝肋下未及，脾肋下刚可触及（ITP一般无肝脾肿大），化验：Hb121g/L（成年女性Hb正常值110～150g/L），WBC4.5×10⁹/L（正常4～10×10⁹/L），PLT25×10⁹/L（正常100～300×10⁹/L）明显减少，临床表现不能排除免疫性血小板减少性紫癜，免疫性血小板减少性紫癜患者可检测到血小板相关抗体，故为除外继发性免疫性血小板减少性紫癜最重要的检查为血小板抗体（B对）检查。免疫性血小板减少性紫癜患者血小板功能（A错）多正常；抗核抗体谱（P817）（C错）主要用于系统性红斑狼疮的诊断；腹部B超（D错）、胸部X线片（E错）不用于血液系统疾病的检查。